停经11周，少量阴道流血3天，子宫符合孕月，宫口未开
A. 流产感染
B. 稽留流产
C. 先兆流产
D. 难免流产
E. 不全流产

正确答案：C。先兆流产

解析：阴道少量阴道流血，子宫符合孕月，宫口未开是先兆流产的典型特点掌握“自然流产”知识点。